表示维生素B₆营养状况良好的黄尿酸指数（XI）的值是
A. 1.2
B. 2.5
C. 5.7
D. 12.6
E. 15.9

正确答案：A。1.2